与体内血浆蛋白高度结合的药物是
A. 卡那霉素
B. 巴比妥
C. 水杨酸钠
D. 地西泮
E. 妥布霉素

正确答案：D。地西泮

解析：本题考查地西泮。与体内血浆蛋白高度结合的药物是地西泮（D对）。蛋白结合率高的药物包括维拉帕米、呋塞米、利多卡因、吗啡、普萘洛尔、地西泮、苯妥英钠和红霉素等。卡那霉素（A错）、巴比妥（B错）、水杨酸钠（C错）、妥布霉素（E错）与血浆蛋白结合率较低。